患者久病湿疹，面垢多眵，大便溏泄，时发下痢脓血，小溲浑浊不清，舌苔白厚腻，脉濡滑，病属湿邪为患，此证反应了湿邪的哪种性质
A. 重着
B. 黏腻
C. 趋下
D. 秽浊
E. 类水

正确答案：D。秽浊

解析：湿邪为患，易出现分泌物和排泄物秽浊不清的特征。若湿浊在上，则面垢、眵多；湿浊下注则小便浑浊或滞涩不利、妇女白带过多；湿滞大肠则大便溏泄、下痢脓血。（D对）。湿性重着（A错）则出现以沉重感及附着难移为特征的临床表现，如头身困重，四肢酸楚沉重并且附着难移。湿性黏腻（B错）则容易阻滞气机，出现分泌物黏滞不爽，病程较长缠绵且反复发作。湿性趋下（C错）则容易伤及人体下部，出现水肿、湿疹、脚气。